焦炉工人所患法定职业肿瘤为
A. 肺癌
B. 皮肤癌
C. 白血病
D. 膀胱癌
E. 肾脏肿瘤

正确答案：A。肺癌

解析：本题考查焦炉工人易患癌种类。烟煤在高温缺氧的焦炉炭化室内干馏过程中产生的气体、蒸气和烟尘统称为焦炉逸散物。煤焦油挥发物是焦炉逸散物的重要成分，含有多种致癌的多环芳烃类化合物。大量的动物实验和流行病学研究表明，长期接触以多环芳烃为代表的焦炉逸散物是焦炉肺癌（A对BCDE错）公认的致癌因素。